可以向医疗机构销售其购进药品的主体是
A. 药品上市许可持有人
B. 中药材专业市场商户
C. 药品零售连锁企业总部
D. 药品批发企业

正确答案：D。药品批发企业

解析：本题考查药品经营管理。可以向医疗机构销售其购进药品的主体是药品批发企业（D对）。医疗机构应当从药品上市许可持有人或者具有药品生产、经营资格的企业购进药品；但是，购进未实施审批管理的中药材和中药饮片除外。